某单位从1985年起对职工心脏病的发病情况进行研究。在1985年每位职工填写了一份关于体育锻炼的调查表，然后对其随访直至2000年。研究者发现：对于调查表中填有每天有规律地锻炼30分钟的职工，在总共4000个观察人年中发生心脏病50例，而锻炼没有规律的职工，在总共3000个观察人年中发生心脏病200例。规律锻炼与心脏病之间的关联强度是
A. 3.2
B. 0.4
C. 0.19
D. 5.3
E. 0.26

正确答案：C。0.19

解析：本题考查相对危险度。相对危险度是指暴露组发病或死亡的危险（50/4000）是非暴露组（200/3000）的多少倍（0.0125/0.0667＝0.1874）（C对ABDE错），即两组危险度之比。